牙板在乳牙胚生成后其远中端继续向远中生长，形成
A. 恒磨牙牙胚
B. Serre上皮剩余
C. 缩余釉上皮
D. 结合上皮
E. 马拉瑟上皮剩余

正确答案：A。恒磨牙牙胚

解析：乳牙胚形成后，牙板的远中端在结缔组织内继续向远中生长，相继形成恒磨牙的牙胚。掌握“牙胚的发生及分化”知识点。